大建中汤的组成药物是
A. 生附子、干姜、肉桂、炙甘草
B. 蜀椒、人参、干姜、胶饴
C. 蜀椒、人参、干姜、炙甘草
D. 蜀椒、生附子、肉桂、胶饴
E. 干姜、人参、桂枝、胶饴

正确答案：B。蜀椒、人参、干姜、胶饴

解析：本题考查大建中汤的药物组成，属记忆内容。大建中汤功用温中补虚，降逆止痛，由蜀椒、干姜、人参、胶饴组成（B对）。记忆：大建中汤建中阳，蜀椒干姜参饴糖；阴盛阳虚腹冷痛，温补中焦止痛强。